患者突然昏迷抽搐，瞳孔明显缩小，皮肤潮冷，多汗，呕吐，流涎，分泌物增加，两肺湿啰音，呼吸困难，应首先考虑的诊断是
A. 有机磷农药中毒
B. 苯胺中毒
C. 一氧化碳中毒
D. 巴比妥类药物中毒
E. 铅中毒

正确答案：A。有机磷农药中毒

解析：有机磷农药中毒的机制是抑制了胆碱酯酶的活性，造成组织中乙酰胆碱的蓄积，其结果引起胆碱能受体活性紊乱，而使有胆碱能受体的器官功能发生障碍，有脏器平滑肌腺体，汗腺等兴奋，而引起一些症状，表现为体内多种腺体分泌增加，多汗，流口水，流眼泪，流鼻涕，肺部干湿啰音，呼吸困难，恶心，呕吐，腹痛等（A对）；苯胺中毒是苯胺进入人体所致疾病，中毒早期表现为紫绀，重症时神志恍惚，步态蹒跚，甚至抽搐昏迷（B错）；一氧化碳中毒因吸入一氧化碳导致人体组织或器官缺氧的一种中毒性疾病，主要症状有头痛、头晕、恶心、头痛、心悸、肢体无力、胸闷、运动协调性下降、嗜睡、意识模糊、口唇呈樱桃红色、呼吸困难、昏迷等（C错）；巴比妥类药物中毒，患者中枢神经系统高度抑制，病人感觉迟缓，言语不清，定向力障碍至深度昏迷，并出现周期性脑电图异常，瞳孔扩大，角膜、咽及腱反射消失，抑制胃肠蠕动，肠鸣音减弱或消失等（D错）；铅中毒是指环境中的铅及其化合物经食物和呼吸途径（部分化合物如四乙铅可经皮肤吸收）进入人体，铅毒主要抑制细胞内含巯基的酶类，临床症状轻者头痛、头晕、噩梦、乏力、纳差、腹痛、腹泻、恶心、呕吐、关节疼痛、大便呈黑色等。重者血压下降、脉率缓慢、幻觉、妄想、烦躁、谵妄全身抽搐甚至瞳孔散大、意识丧失等（E错）。